社会定点药房的执业药师在销售过程中要
A. 向社区群众交代药品的用法
B. 有条件的可为社区群众建立药历卡
C. 和坐堂医师一样诊断、开方、拿药
D. 解答群众用药咨询，同时向社区医师反馈信息
E. 为社区和街道的经济做贡献

正确答案：A、B、D。向社区群众交代药品的用法；有条件的可为社区群众建立药历卡；解答群众用药咨询，同时向社区医师反馈信息